对于大多数在小学里学习成绩中等的孩子而言，可以判断其智力水平处于正常范围，这一心理健康判断的角度为
A. 文化学角度
B. 社会学角度
C. 人类学角度
D. 统计学角度
E. 病理学角度

正确答案：D。统计学角度

解析：在普通人群中，对人们的智力进行测量的结果常常显示正态分布，居中的大多数人属于正常智力，小学里学习成绩中等即正态分布的居中人群，判断其智力水平处于正常范围，是从统计学角度（D对）进行的判断。社会学角度（B错）是从行为后果对本人或社会是否适应的角度进行分析的。病理学角度是从大脑组织结构是否正常的角度进行分析的。文化学角度（A错）、人类学角度（C错）教材未明确提及。